足少阴肾经在胸部的循行为旁开前正中线
A. 0.5寸
B. 1.5寸
C. 2寸
D. 4寸
E. 6寸

正确答案：C。2寸

解析：该题考查经脉在胸腹部的循行。足少阴肾经在胸部的循行为前正中线旁开2寸（C对），位于胸部第一侧线。